使氧解离曲线右移的因素
A. pH值↓
B. CO₂分压↑
C. 温度↑的影响
D. 2，3-二磷酸甘油↑
E. 以上都对

正确答案：E。以上都对